脑膜瘤复发的重要因素是
A. 年龄
B. 组织类型
C. 肿瘤部位
D. 性别
E. 术后肿瘤残余

正确答案：E。术后肿瘤残余

解析：脑膜瘤为良性脑外肿瘤，肿瘤边界清，生长缓慢，如能根治，多预后良好。脑膜瘤复发的主要影响因素是术后肿瘤残余（E对），术后残留越多，肿瘤复发率越高。此外，肿瘤的部位（C错）、组织类型（B错）等因素也可影响肿瘤的复发。年龄（A错）、性别（D错）与脑膜瘤的发病有一定的相关性，但对脑膜瘤的复发影响不大。